在社区卫生服务中POMR是指
A. 以问题为导向的医疗记录
B. 周期性健康检查记录
C. 初级卫生保健
D. 社区卫生服务
E. 人性化服务

正确答案：A。以问题为导向的医疗记录

解析：本题考查POMR。在社区卫生服务中的POMR是指以问题为导向的医疗记录（A对BCDE错）。